预防干槽症下列哪项是错误的
A. 减少手术创伤
B. 尽量延长局部压迫止血时间
C. 注意无菌操作
D. 注意口腔卫生
E. 保护拔牙创内血凝块

正确答案：B。尽量延长局部压迫止血时间

解析：本题考查干槽症的预防。预防干槽症错误的是尽量延长局部压迫止血时间（B错，为本题的正确答案）。拔牙后15～30min后出血即停止，形成血凝块封闭创口，因此30min左右取出压迫棉卷即可；延长压迫时间，棉卷和血凝块会粘到一起，若此时取下棉卷很可能将血凝块一并取下，继而可能引起干槽症。创伤使骨组织易发生继发感染，故减小手术创伤（A对）可预防干槽症。注意无菌操作（C对）和口腔卫生（D对）可以减少继发感染的机会预防干槽症。血凝块是拔牙创口愈合的基础，故保护拔牙创内血凝块（E对）可预防干槽症。